甲状腺功能亢进的治疗药物是
A. 丙硫氧嘧啶
B. 甲巯咪唑
C. 甲状腺素
D. 放射性碘
E. 碘化物

正确答案：A、B、D、E。丙硫氧嘧啶；甲巯咪唑；放射性碘；碘化物

解析：本题考查甲亢的治疗药。常用的治疗甲亢的药物：1.硫脲类，如甲硫氧嘧啶、丙硫氧嘧啶（A对）、甲巯咪唑（B对）、卡比马唑等。2.碘及碘化物（E对），如复方碘溶液、碘化钾、碘化钠等。3.放射性碘（D对）。4.β受体拮抗剂，如普萘洛尔、美托洛尔、阿替洛尔等。甲状腺素（D错）用于治疗甲状腺功能减退症。